患者饱餐后上腹部持续疼痛1天。查体：上腹中部及左上腹有横行带状压痛及肌紧张，并涉及左腰部。应首先考虑的是
A. 肝肿瘤
B. 左肾结石
C. 急性肝炎
D. 急性胰腺炎
E. 急性胃炎

正确答案：D。急性胰腺炎

解析：本例患者于饱餐后出现持续性上腹部疼痛，查体：上腹中部及左上腹有横行带状压痛及肌紧张，并涉及左腰部，故诊断首先考虑是急性胰腺炎（D对）。肝肿瘤（A错）患者主要表现为肝区疼痛、肝大等，查体常可发现肝脏质地坚硬，表面凹凸不平，常有大小不等的结节。左肾结石（B错）患者主要表现为腰痛、血尿，部分患者可有恶心、呕吐以及膀胱刺激症状。急性肝炎（C错）患者主要表现为全身疲乏无力、食欲减退、肝区不适，严重者可出现黄疸，部分患者查体可发现有肝区压痛。急性胃炎（E错）多见于口服非甾体抗炎药患者，主要表现为无规律上腹痛，查体多无阳性体征。